下列哪项检查要用造影显示
A. 根尖囊肿
B. 鼻腭管囊肿
C. 甲状舌管瘘
D. 孤立性骨囊肿
E. 角化囊肿

正确答案：C。甲状舌管瘘

解析：甲状舌管囊肿的诊断可根据其部位和随吞咽移动等而做出。有时穿刺检查可抽出透明、为浑浊的黄色稀薄或黏稠性液体。对甲状舌管囊肿还可以进行碘油造影以明确其瘘管行径。掌握“甲状舌管囊肿及鳃裂囊肿”知识点。